患者，女，28岁。妊娠足月，剖宫产后1周，持续低热，午后为甚，体温37.8℃~38.3℃，褥汗多，恶露量少，色淡质稀，小腹绵绵而痛，面色苍白，头晕目眩，舌淡红，脉虚略数。诊断为产后发热，其证型是
A. 感染邪毒
B. 热入营血
C. 实热瘀血内结阳明
D. 血瘀发热
E. 血虚发热

正确答案：E。血虚发热

解析：患者产后一周开始发热，持续低热，午后为甚是因为产后失血伤津，阴血骤虚，阴不敛阳，虚阳外浮，故低热缠绵，自汗。血虚胞脉失养故腹痛绵绵、喜按。气随血耗，则面色苍白，冲任不固，故恶露量多，血虚冲任不足则量少，色淡质稀。血虚心脑失养，则头晕目眩。故中医诊断为产后血虚发热证（E对）。感染邪毒而发热多表现为高热寒战，热势不退，小腹疼痛难忍，恶露色紫黯如败血，气臭秽，心烦口渴等症状（A错）。热入营血多表现为局部肿胀，身热夜甚，烦渴，舌红绛，脉数等热象（B错）。实热瘀血内结阳明为邪热内盛于里，邪热与肠中糟粕相搏，燥屎内结，阻滞肠道，常表现为日哺潮热，手足汗出，脐腹胀痛，疼痛拒按，大便秘结不通等实热症状，并伴有腹部积块明显，质地较硬，固定不移，隐痛或刺痛，形体消瘦，纳谷减少，面色晦暗黧黑，面颈胸臂或有血痣赤缕，产后恶露不尽，舌质紫或有瘀斑瘀点，脉细涩等瘀血内结之征（C错）。血瘀发热多见产后寒热时作，恶露不下或下亦甚少，色紫黯有块，小腹疼痛拒按。舌质紫黯或有瘀点，脉弦涩（D错）。